广谱抗真菌药物是
A. 利福平
B. 利巴韦林
C. 伯氨喹
D. 氟康唑
E. 环磷酰胺

正确答案：D。氟康唑

解析：利福平是广谱抗菌药（A错），对结核分枝杆菌、麻风杆菌、革兰氏阳性菌尤其耐药性金黄色葡萄球菌有强大的抗菌作用；较大浓度时对革兰氏阴性菌、某些病毒和沙眼衣原体也有抑制作用。利巴韦林（B错）又名病毒唑，为广谱抗病毒药，对多种RNA和DNA病毒有抑制作用。伯氨喹（C错）是抗疟药，能杀灭肝脏中休眠子，控制疟疾的复发；并能杀灭各种疟原虫的配子体，控制疟疾传播。氟康唑（D对）具有广谱抗真菌包括隐球菌属、念珠菌属和球孢子菌属等作用，体内抗真菌活性较酮康唑强5-20倍。环磷酰胺（E错）是常用的烷化剂，是免疫抑制药，常用于防止排斥反应与移植物抗宿主反应；也可与其他抗肿瘤药物合用治疗一些恶性肿瘤。